3位侧链上含有1-甲基四唑基
A. 头孢氨苄
B. 头孢羟氨苄
C. 头孢噻吩钠
D. 头孢噻污钠
E. 头孢哌酮

正确答案：E。头孢哌酮